T10的前支的分布平面相当于
A. 胸骨角平面
B. 乳头平面
C. 剑突平面
D. 脐平面
E. 无

正确答案：D。脐平面

解析：T2分布区相当于胸骨角平面（A错），T4相当于乳头平面（B错），T6相当于剑突平面（C错），T10相当于脐平面（D对）。